发生于肩胛舌骨肌水平以上者的鳃瘘的来源多为
A. 第一鳃裂来源
B. 第二鳃裂来源
C. 第三鳃裂来源
D. 第四鳃裂来源
E. 第五鳃裂来源

正确答案：B。第二鳃裂来源

解析：发生于约相当肩胛舌骨肌水平以上者多为第二鳃裂来源。掌握“鳃弓与神经嵴”知识点。